不是克山病的致病原因的是
A. 环境硒水平过低
B. 柯萨奇病毒感染
C. 营养素失衡
D. 环境硒水平过高
E. 真菌污染粮食

正确答案：D。环境硒水平过高

解析：本题考查克山病的致病原因。克山病是一种以心肌变性坏死为主要病理改变的生物地球化学性疾病。其致病原因有：1.环境硒水平过低（A对）：“环境低硒”是克山病发生、发展、流行的主要原因（D错，为本题正确答案）；2.生物感染因素：柯萨奇病毒B组（COXB₁～₆）（B对）和真菌感染（E对）可能是引起克山病的原因之一；3.膳食中营养素失衡（C对）：克山病流行区居民膳食中除缺硒外，常同时伴有优质蛋白、钙、铁、锌、维生素B族和维生素E等营养素的缺乏。